某女暑假经常是白天上网，晚上躺在床上看小说。等到开学，发现黑板上的字看不太清楚，便去校医室检查。检查右眼时，5.0和4.9行视标都看不清，4.8行认错2个，4.7行认错1个，4.6行全部认对。左眼检查结果相同。检查结果是右眼5.0，左眼5.1，表明
A. 远视力正常
B. 远视力异常
C. 近视力正常
D. 近视力异常
E. 屈光正常

正确答案：C。近视力正常